《金匮要略》中“饮水流行，归于四肢，当汗出而不汗出，身体疼痛重”为
A. 支饮
B. 消渴
C. 痰饮
D. 悬饮
E. 溢饮

正确答案：E。溢饮

解析：痰饮又可分为痰饮、悬饮、溢饮和支饮四种类型。由于总的病名为痰饮，具体辨证中又有痰饮一证，所以前人对痰饮一词的解释有广义与狭义之分。前者是四种痰饮的总称，后者仅指痰饮留于肠胃的一种类型。痰饮病的形成与人体水液代谢失常密切相关，多由肺、脾、肾气化失常，三焦通调水道失职，影响体内水液的运化、敷布和排泄、水饮停留于不同部位而形成，尤其以脾气虚不能为胃游溢精气为主要病机。痰饮是水饮聚于胃肠，与脾关系致密。由于水饮的流动与气相击。故肠间发出沥沥声响。健康之人运化正常，饮食入胃以后化为精微，充养全身，故肌肉丰盛。今脾运不及、饮食不化精微，反停聚而成为痰饮，致肌肉不得充养，所以形体消瘦（C错）。悬饮是水饮流注于胁下，累及肝肺。胁下为肝之居所，肝经支脉贯膈，上注于肺，饮邪潴留于胁下，循经上逆射肺，致肝气不升，肺气不降，气机逆乱则产生咳嗽，并牵引胁下作痛（D错）。溢饮是水饮阻于四肢肌表，责之肺脾之脏。因脾主肌肉，肺主皮毛，若脾阳不运，则水饮外溢四肢；渗溢肌肤之水饮本可随汗液排泄、若肺失宣降，腠理开阖失职，当汗而不能汗，阻遏营卫的运行，则致身体疼痛而重滞（E对）。支饮是水饮停留于胸膈，影响心肺。饮聚胸膈，凌心射肺。肺失宣降，心阳被遏则咳嗽气逆，短气不能平卧，须倚床呼吸；肺合皮毛，水随气逆，故兼见外形如肿（A错）。